引起鹅口疮的病原体是
A. 絮状表皮癣菌
B. 石膏样小孢子菌
C. 口腔链球菌
D. 白假丝酵母菌
E. 口腔螺旋体

正确答案：D。白假丝酵母菌

解析：鹅口疮又名雪口病白念菌病，鹅口、雪口、鹅口疳、鹅口白疮。是由真菌传染，在粘膜表面形成白色斑膜的疾病多见于婴幼儿。本病是白色念珠菌感染所引起。这种真菌有时也可在口腔中找到当婴儿营养不良或身体衰弱时可以发病。新生儿多由产道感染，或因哺乳奶头不洁或喂养者手指的污染传播。掌握“真菌概述及主要病原性真菌”知识点。